冠状动脉
A. 属肺循环动脉
B. 起自胸主动脉
C. 前室间支发自右冠状动脉
D. 仅分布于心室
E. 阻塞后易引起心肌梗死

正确答案：E。阻塞后易引起心肌梗死

解析：冠状动脉属冠状循环（A错）动脉。起自升主动脉（B错）。前室间支发自左冠状动脉（C错）。冠状动脉不仅分布于心室（D错），还分布于心房、室间隔等。冠状动脉阻塞后易引起心肌梗死（E对）。